以下不属于环境与健康监测的范围的是
A. 对水质的监测
B. 对环境污染的监测
C. 对健康危害因素的监测
D. 对健康相关产品的监测
E. 对营养与食品安全的危险性评估

正确答案：E。对营养与食品安全的危险性评估

解析：健康相关危险因素监测系统：包括营养与食品安全监测和环境与健康监测。前者通过监测，评估营养与食品安全的危险性；后者是对水质、环境污染及其健康危害和健康相关产品进行监测、评价和预警。掌握“流行病的诊断和筛检试验及疾病监测”知识点。